中枢化学感受器敏感的刺激物是
A. 血液中的CO₂
B. 脑脊液中的CO₂
C. 血液中的H⁺
D. 脑脊液中的H⁺
E. 动脉血O₂分压降低

正确答案：D。脑脊液中的H⁺